公孙穴所通的奇经是
A. 任脉
B. 督脉
C. 冲脉
D. 阳维脉
E. 阳跷脉

正确答案：C。冲脉

解析：本题考查八脉交会穴。八脉交会穴手太阴肺经上的列缺通于任脉（A错）。手太阳小肠经上的后溪通于督脉（B错）。足太阴脾经的公孙通于冲脉（Ｃ对）。手少阳三焦经上的外关通于阳维脉（D错）。足太阳膀胱经上的申脉通于阳跷脉（E错）。此外，本题中尚未提及的与带脉、阴维脉、阴跷脉相通的八脉交会穴也要熟练掌握。足少阳胆经上的足临泣通于带脉，手厥阴心包经上的内关通于阴维脉，足少阴肾经上的照海通于阴跷脉。记忆：牢记八脉交会八穴歌。